椎前神经节不出现
A. 腹腔神经节
B. 星状神经节
C. 主动脉肾神经节
D. 肠系膜上神经节
E. 肠系膜下神经节

正确答案：B。星状神经节

解析：椎前神经节包括腹腔神经节（A对）,肠系膜上神经节（D对），肠系膜下神经节（E对）及主动脉肾神经节（C对）等，星状神经节（B错，为本题正确选项）为颈胸神经节。